变异系数是
A. 描述计量资料平均水平的指标
B. 描述计量资料绝对离散程度的指标
C. 描述计量资料相对离散程度的指标
D. 描述计数资料各部分构成的指标
E. 描述计数资料平均水平的指标

正确答案：C。描述计量资料相对离散程度的指标

解析：本题考查变异系数的相关内容。变异系数是一个度量相对离散程度的指标（C对ABDE错），是变异大小（s）相对于其平均水平（x̅）的百分比，为了解单位相同但均数相差悬殊的变量之间的变异程度，以及比较几个不同单位的变量的变异程度，可把标准差除以均数，所得到的指标称为变异系数。